左心室侧壁梗塞常由
A. 后室间支闭塞引起
B. 旋支闭塞引起
C. 左室后支闭塞引起
D. 前室间支闭塞引起
E. 动脉圆锥闭塞引起

正确答案：B。旋支闭塞引起

解析：旋支及其分支分布于左室侧壁，当左心室侧壁梗塞时，常由旋支闭塞引起（B对）。